某中学的校医，每学期都会给所有在校学生检查一次视力，视力表摆放在校医室。按照卫生要求，每次检查视力前，张丽都会测量视力表表面的亮度，保证不低于
A. 300lx
B. 350lx
C. 400lx
D. 450lx
E. 500lx

正确答案：E。500lx